在结核病住院的妇女中，某医师研究了经常性肺部X线检查对继发乳腺癌的影响，发现射线暴露组和非暴露组分别有25％和11.7％的人接受过雷米封化学治疗。如果雷米封可诱发癌症，在分析肺部X线检查与乳腺癌发生的关系时，下列方法哪个可以排除两组因服雷米封人数比例不同而造成的干扰
A. 只在未用过雷米封的人中比较乳腺癌的发生率
B. 将射线暴露组和非暴露组妇女分为用过雷米封组和未用过雷米封组
C. 进行配比分析，病例对照的比值等于两组中使用雷米封人数的比值，再计算比值比
D. 对射线暴露组和非暴露组使用雷米封的分布情况进行校正，计算SMR
E. 以上都不对

正确答案：B。将射线暴露组和非暴露组妇女分为用过雷米封组和未用过雷米封组